影响谷物中矿物质吸收利用的成分是
A. 氨基酸
B. 支链淀粉
C. 直链淀粉
D. 果糖
E. 植酸

正确答案：E。植酸

解析：本题考查影响谷物中矿物质吸收利用的成分。影响谷物中矿物质吸收利用的成分是植酸（E对ABCD错）。